下列关于结肠左曲的描述，正确的是
A. 位置较结肠右曲低
B. 位于左肾下方
C. 膈结肠韧带连于左曲
D. 下续乙状结肠
E. 以上全错

正确答案：C。膈结肠韧带连于左曲

解析：结肠左曲位置略高于结肠右曲(A错)，位于脾下方(B错)，膈结肠韧带与结肠左曲相连(C对)，其下续降结肠(D错)。